男，52岁，近2个月来大便次数增多，有肛门坠胀感及里急后重，大便变细，常有粘液血便，经抗生素治疗症状可缓解，但不久又复发，且呈进行性加重。术后可不追加化疗的条件是
A. DukesA期
B. DukesB期
C. DukesC1期
D. DukesC2期
E. DukesD期

正确答案：A。DukesA期

解析：患者老年男性，有肛门坠胀感及里急后重（直肠刺激症状），大便变细（大便变形），且有血便，症状呈进行性加重（符合直肠癌的典型临床表现），诊断为直肠癌。直肠癌的术后化疗适用于DukesB、C、D期患者，DukesA期由于病变局限于肠壁内，且化疗副作用太大，故可不追加化疗（A对）。